在药品外包装上不需印刷专有标识的是
A. 甲类非处方药
B. 乙类非处方药
C. 特殊管理的药品
D. 一般处方药品
E. 仅供外用的药品

正确答案：D。一般处方药品

解析：本题考查药品包装管理。在药品外包装上不需印刷专有标识的是一般处方药品（D错，为本题正确答案）。麻醉药品、精神药品、医疗用毒性药品、放射性药品、外用药品（E对）和非处方药（AB对）的标签、说明书，应当印有规定的标志。国家对麻醉药品、精神药品、医疗用毒性药品、放射性药品，实行特殊管理（C对）。